麦芽的功效是
A. 消食回乳
B. 消食散瘀
C. 消食化痰
D. 消食止痛
E. 消食杀虫

正确答案：A。消食回乳

解析：本题考查的是麦芽的功效。麦芽的功效是消食回乳（A对）。麦芽：【功效】消食和中，回乳，疏肝。山楂：【功效】消食化积，活血散瘀（B错）。莱菔子：【功效】消食除胀，降气化痰（C错）。木香：【功效】行气止痛，健脾消食（D错）。使君子：【功效】杀虫消积（E错）。